内分泌功能减退性疾病目前较普遍使用的替代治疗方法是给予
A. 生理剂量的靶腺激素
B. 药理剂量的靶腺激素
C. 药理剂量的促垂体激素
D. 药理剂量的垂体激素
E. 调节神经递质或受体的药物

正确答案：A。生理剂量的靶腺激素

解析：内分泌功能减退性疾病目前较普遍使用的替代治疗方法是给予生理剂量的靶腺激素（A对）作替代治疗或补充治疗。药理剂量（BCD错）是用来治疗症状的量，一般为生理剂量的10倍。调节神经递质或受体的药物（E错）是内分泌功能亢进性疾病的治疗方法。